患者胸骨下部显著前突，左、右胸廓塌陷。肋骨与肋软骨交界处变厚增大，上下柑连呈串珠状。其诊断是
A. 肺结核
B. 佝偻病
C. 肺气肿
D. 支气管哮喘
E. 肺纤维化

正确答案：B。佝偻病

解析：佝偻病胸为佝偻病（B对）所致的胸廓改变，多见于儿童。沿胸骨两侧各肋软骨与肋骨交界处常隆起，形成串珠状，谓之佝偻病串珠；下胸部前面的肋骨常外翻，沿膈附着的部位其胸壁向内凹陷形成的沟状带，称为肋膈沟；若胸骨剑突处显著内陷，形似漏斗，谓之漏斗胸；胸廓的前后径略长与左右径，其上下距离较短，胸骨下端常前突，胸廓前侧壁肋骨凹陷，称为鸡胸。肺结核（A错）不引起肋骨及肋软骨的病变，但当有较大范围的纤维条锁形成时，可导致患侧胸廓塌陷；结核性胸膜炎引起胸腔积液时可有胸廓饱满。肺气肿（C错）者胸廓前后径增大，呈桶状胸，呼吸运动减弱，语音震颤减弱，叩诊过清音。支气管哮喘（D错）发作期因过度通气，胸廓可呈现饱满，缓解期如常，而不会累及肋骨及肋软骨病变。特发性肺纤维化（E错）是一种慢性、进行性、纤维化性间质性肺炎。主要表现为活动性呼吸困难，进行性加重，根据HRCT确诊。